哌替啶的临床应用
A. 镇痛
B. 人工冬眠
C. 心源性哮喘
D. 麻醉前给药
E. 以上说法均正确

正确答案：E。以上说法均正确

解析：哌替啶临床可用于：①镇痛；②心源性哮喘；③麻醉前给药及人工冬眠。掌握“吗啡、哌替啶”知识点。